男，46岁，右颈部无痛性淋巴结肿大4个月，伴上腹疼痛，食欲不佳，发热盗汗，体重减轻。行剖腹探查见胃与胰头及腹膜有粘连，周围有多个肿大的淋巴结，病理检查为霍奇金淋巴瘤，T细胞来源。临床分期属
A. ⅡB
B. ⅢA
C. ⅢB
D. ⅣA
E. ⅣB

正确答案：E。ⅣB

解析：患者病理检查已确诊为霍奇金淋巴瘤，现进行临床分期：右颈部无痛性淋巴结肿大，剖腹探查见胃与胰头及腹膜有粘连，周围有多个肿大的淋巴结（多个结外器官受侵犯伴有周围淋巴结肿大）提示为Ⅳ期，患者同时伴上腹疼痛，食欲不佳，发热、盗汗、体重减轻（1.不明原因发热大于38℃；2.盗汗；3.半年内体重下降10%以上，伴有其中一项者分为B组）提示为B组，故患者临床分期为ⅣB期（E对）。